男56岁，上腹痛，检查见胃角浅表溃疡，活检示高级别上皮内瘤变，WS（+），问作何治疗
A. 四联疗法后HP复查
B. 胃次全切+根治术
C. 内镜下行黏膜剥离术
D. 胃大部切除术
E. 观察随访

正确答案：C。内镜下行黏膜剥离术

解析：胃癌首选胃癌根治术，早期胃癌仅限于黏膜层和黏膜下层，首选内镜下黏膜切除术。由于胃癌导致的梗阻、穿孔、出血等并发症而做的手术为姑息性手术。该患者男56岁，出现上腹痛，检查见胃角浅表溃疡，活检示高级别上皮内瘤变，WS（+），应行胃镜下行黏膜下剥离术（C对）。